有周期性排卵和行经，具有生殖功能的时期称为
A. 幼年期
B. 青春期
C. 性成熟期
D. 绝经后期
E. 绝经过渡期

正确答案：C。性成熟期

解析：性成熟期是卵巢生殖功能与内分泌功能最旺盛时期。18岁开始，历时约30年，此期卵巢功能成熟，出现周期性排卵。生殖器官各部及乳房，在卵巢分泌的性激素作用下发生周期性变化。掌握“女性生殖系统生理”知识点。